对雷尼替丁，哪项错误
A. 可用于治疗皮肤黏膜过敏症
B. 是H₂受体阻断药
C. 可用于治疗胃和十二指肠溃疡
D. 对反流性胃炎也有效
E. 长期用药不引起性激素失调

正确答案：A。可用于治疗皮肤黏膜过敏症